利用放射性同位素诊断或治疗疾病或进行医学研究的技术的是
A. 放射治疗
B. 核医学
C. 介入放射学
D. X射线影像诊断
E. B超

正确答案：B。核医学

解析：核医学：是指利用放射性同位素诊断或治疗疾病或进行医学研究的技术。掌握“放射诊疗的概念分类及执业条件”知识点。